治疗急性髓细胞白血病普遍采用的标准化疗方案是
A. VP
B. DA
C. CHOP
D. MOPP
E. MP

正确答案：B。DA

解析：治疗急性髓细胞白血病普遍采用的标准化疗方案是DA方案（B对）。VP方案（P575）（A错）是急性淋巴细胞白血病的基础用药；CHOP（P590）（C错）方案是侵袭性非霍奇金淋巴瘤的标准治疗方案；MOPP（D错）是为霍奇金淋巴瘤的化疗方案，现已被ABVD方案取代为首选方案；MP（E错）为多发性骨髓瘤的化疗方案。